休克的发生主要由于
A. 中枢神经系统的抑制
B. 血压下降
C. 重要生命器官低灌流和细胞功能代谢严重障碍
D. 交感-肾上腺系统衰竭
E. 中心静脉压降低

正确答案：C。重要生命器官低灌流和细胞功能代谢严重障碍

解析：休克的发生主要由于有效循环血量急剧减少，组织、重要生命器官血液灌流量严重不足，引起细胞缺血、缺氧，以致细胞的功能、代谢障碍或结构损害（C对ABDE错）。